在对两个样本均数作假设检验时，若P＞0.1，则统计推断为
A. 两总体均数的差别有统计学意义
B. 两样本均数的差别有统计学意义
C. 有0.9的把握度认为两总体均数无差别
D. 犯第Ⅱ类错误的概率为0.1
E. 两总体均数的差别无显著性

正确答案：E。两总体均数的差别无显著性